磨片在显微镜下显粗细相间排列的同心环纹层纹的是
A. 石决明
B. 珍珠
C. 鹿茸
D. 海螵蛸
E. 牡蛎

正确答案：B。珍珠

解析：本题考查的是珍珠的显微鉴别。磨片在显微镜下显粗细相间排列的同心环纹层纹的是珍珠（B对）。珍珠【显微鉴别】磨片：呈类圆形，可见同心性环状层纹，称为“珍珠结构环”，粗层纹较明显，连续成环或断续成环，层纹间距不等，在60～500㎛间；粗层纹间有细层纹，细层纹在有些部位较明显，多数不甚明显，少数不明显。石决明（A错）【显微鉴别】皱纹盘鲍：将贝壳按与生长线相垂直的方向锯开磨制成纵断面，与生长线相平行的方向锯开磨制成横断面。纵、横断面分为三层：①外层为角质层，极薄，呈黑褐色，粗糙并呈角质状。②中层为棱柱层，厚，白色，长条的棱柱垂直排列于内、外层间。③内层为珍珠层，较厚，银白色，并具紫、粉红、绿等五彩光泽。鹿茸（C错）【显微鉴别】横切面：①由外皮和骨小梁构成。②外皮主要由表皮层和真皮层构成。③表皮层包括半透明角质层、鳞状细胞层、颗粒细胞层。④真皮包括乳头层、网状层和胶原纤维层。⑤外皮和骨小梁之间有2～6层半透明的梭形细胞，排列密集，染色后，细胞核明显。⑥靠近梭形细胞的骨小梁间隙中有血痕。海螵蛸（D错）【显微鉴别】粉末类白色，多数为不规则透明薄片，有的具细条纹；另有不规则碎块，表面显网状或点状纹理。主含碳酸钙。